11、13、16、21、23、26、31、32、33、36、41、42、43、46釉质发育不全，表明致病因素发生于
A. 胎儿期
B. 1岁内
C. 1～2岁
D. 2岁以后
E. 3岁以后

正确答案：B。1岁内

解析：本题考查牙釉质发育不全。由于致病因素出现在牙发育期才会导致釉质发育不全，故可以根据釉质发育不全的部位，推断致病因素作用的时间。因11、13、16、21、23、26、31、32、33、36、41、42、43、46的釉质沉积是在1岁以内，故出现釉质发育不全，表示致病因素发生在1岁以内（B对A错）。12、22的釉质和牙本质在出生后一年左右才开始沉积，当12、22的切缘被累及时，可推断致病因素已累及到出生后第2年（C错）。如前牙未累及，主要表现在14、15、17、24、25、27、34、35、37、45、44、47，则致病因素发生在2～3岁以后（DE错）。